正常机体内水、电解质的动态平衡主要是通过什么作用来调节？
A. 神经系统
B. 内分泌系统
C. 神经-内分泌系统
D. 肾、肺
E. 胃肠道

正确答案：C。神经-内分泌系统

解析：正常情况下，体内水和电解质的动态平衡主要通过神经-内分泌系统（C对）来调节，当体内水分过少或摄盐过多引起细胞外渗透压增高时，一方面刺激下丘脑的口渴中枢，引起口渴的感觉，机体主动饮水，另一方面促使抗利尿激素（ADH）分泌增多，加强肾远曲小管和集合管对水的重吸收，减少水的排出；同时抑制醛固酮的分泌，减弱肾小管对Na＋的重吸收，增加Na＋的排出，降低了Na＋在细胞外液的浓度，使已升高的细胞外液渗透压降至正常。反之，当体内水分过多或摄盐不足而使细胞外渗透压降低时，一方面通过抑制ADH的分泌，减弱肾远曲小管和集合管对水的重吸收，使水分排出增多；另一方面促进醛固酮的分泌，加强肾小管对Na＋的重吸收，减少Na＋的排出，从而使细胞外液中的Na＋浓度增高，结果已降低的细胞外液渗透压增至正常。